患者，女性，52岁，左上后牙龈反复起疱半年，疱破后出现疼痛，探针不能探入糜烂面边缘。可发现基底膜区抗体的方法是
A. 间接免疫荧光检查
B. 直接免疫荧光检查
C. 血清免疫球蛋白检查
D. 脱落细胞培养
E. 组织病理学检查

正确答案：B。直接免疫荧光检查

解析：本题考查黏膜类天疱疮的检查方式。患者女，52岁，左上后牙龈反复起疱半年（迁延不愈），疱破后出现疼痛，探针不能探入糜烂面边缘（探针试验阴性）。此患者可发现基底膜区抗体的方法是直接免疫荧光检查（B对）。取邻近损害的外观正常黏膜行直接免疫荧光检查，可见基底膜带IgG和/或C3呈线状沉积，偶有IgA、IgM。间接免疫荧光检查（A错）可见患者血清中的IgG在底物的基底膜带呈线状沉积，但该检查敏感度低，仅为10％。血清免疫球蛋白检查（C错）示血清中存在特异性抗BP180或针对黏膜类天疱疮其他分子靶抗原的抗体。脱落细胞培养（D错）需结合直接或间接免疫荧光检查方能显示lgG沉积于表皮侧或真皮。组织病理学检查（E错）可见上皮下疱，但无法观察到抗体。